根据疫苗流通和预防接种管理条例，药品批发职业申请新增疫苗经营业务，应当具备的条件包括
A. 具有从事疫苗管理的专业技术人员
B. 具有保证疫苗质量的冷藏设备和冷藏运输工具
C. 具有当地政府采购第一类疫苗的采购合同
D. 具有符合疫苗储存运输管理规范的管理制度
E. 具有药品检验机构依法签发的每批检验合格证明文件

正确答案：A、B、D。具有从事疫苗管理的专业技术人员；具有保证疫苗质量的冷藏设备和冷藏运输工具；具有符合疫苗储存运输管理规范的管理制度

解析：本题考查从事疫苗经营活动的条件、审批主体和许可。药品批发企业申请从事疫苗经营活动的条件：具有从事疫苗管理的专业技术人员（A对）；具有保证疫苗质量的冷藏设施、设备和冷藏运输工具（B对）；具有符合疫苗储存、运输管理规范的管理制度（D对）。